主动脉起于
A. 右心房
B. 左心房
C. 左心室
D. 右心室
E. 左心室流入道

正确答案：C。左心室

解析：主动脉起于左心室（C对），是体循环的动脉主干，其起始段为升主动脉。